口服避孕药或用异烟肼治疗结核病时，应增加（）的摄入
A. 维生素B₁
B. 维生素B₂
C. 烟酸
D. 维生素B₆
E. 维生素B₁₂

正确答案：D。维生素B₆